根据哪几个方面的资料分析来进行职业中毒的诊断
A. 现场调查、体格检查
B. 接触毒物的作业工龄、工种及劳动条件
C. 有毒物质的种类、浓度及接触时间
D. 体格检查、职业史及现场调查
E. 职业史、劳动条件及毒物的种类

正确答案：D。体格检查、职业史及现场调查